不应列为心理应激对健康的消极影响的是
A. 使已有的疾病加重
B. 适应性调整，恢复内稳态
C. 使原有的疾病复发
D. 损害适应能力，引发心身症状
E. 与其他因素共同影响引发新的疾病

正确答案：B。适应性调整，恢复内稳态

解析：应激的消极意义：①频繁、强烈而突发过度的应激可造成机体唤醒障碍（唤醒不足或过度），耗损过度，适应能力减弱，使心身功能和社会活动障碍，作业能力受损，工作、学习效率下降，引发事故和车祸。②持久和慢性应激，使机体处于适应不良和易感状态，耗竭机体储备，神经内分泌功能紊乱，免疫功能下降，导致心身疾病，引发精神障碍，加重原有的躯体和精神疾病。③应激引起适应不良，造成个体认知上的悲观预测，社会适应功能下降，出现行为障碍。掌握“心理应激”知识点。